对一年前做过口腔检查的二百人进行口腔健康检查时，发现又有20人新发生龋，描述这种新发龋情况的指标是
A. 龋均
B. 患龋率
C. 发病率
D. 构成比
E. 充填率

正确答案：C。发病率

解析：通常是指至少在一年时间内，某人群新发生龋病的频率。与患龋率不同的是仅指在这个特定时期内，新龋发生的频率。掌握“龋病流行病学”知识点。